有关急性化脓性腮腺炎治疗的说法中，错误的是
A. 可进行放疗治疗
B. 可进行热敷
C. 可行切开引流
D. 可选用有效抗生素
E. 加强口腔卫生护理

正确答案：A。可进行放疗治疗

解析：急性化脓性腮腺炎治疗：①维持正确出入量及体液平衡，纠正机体脱水和电解质紊乱。②选用有效抗生素及早用广谱、抗革兰阳性球菌抗生素，同时从导管口取脓性分泌物作细菌培养，根据药物敏感试验结果再予以调整。③加强口腔卫生护理。④切开引流。⑤其他保守治疗包括热敷、理疗及增进唾液分泌等。掌握“急性化脓性腮腺炎”知识点。